患者，男，36岁，在静脉滴注复方氨基酸注射液过程中，穿刺部位出现水肿。可选用的治疗方法是
A. 50%葡萄糖注射液湿敷
B. 50%硫酸镁溶液口服
C. 25%硫酸镁注射液稀释后静脉注射
D. 5%氯化钙注射液静脉滴注
E. 50%硫酸镁溶液湿敷

正确答案：E。50%硫酸镁溶液湿敷

解析：本题考查硫酸镁剂型与给药途径的选择。50%硫酸镁溶液湿敷（E对）可消除水肿。不同的给药途径药物作用也不同。例如硫酸镁静脉注射可用于治疗子痫，而口服则用于导泻，湿敷则消肿。